营养学上所指的人体能量消耗包括
A. 基础代谢
B. 体力活动
C. 食物热效应
D. 以上都是
E. 以上都不是

正确答案：D。以上都是